化生天癸的物质基础是
A. 元气
B. 肾精
C. 宗气
D. 肝气
E. 肾气

正确答案：B。肾精

解析：机体生殖器官的发育，性功能的成熟与维持，以及生殖能力等，取决于肾中精气的盛衰。出生之后，由于肾精及肾气的不断充盈，天癸随之产生（B对）。元气指以先天精气为基础，赖后天精气充养，而根源于肾的气。元气的生理功能主要有两个方面：一是推动和调节入体的生长发育和生殖功能；二是推动和调节各脏腑、经络、形体、官窍的生理活动。元气不直接化生天癸（A错）。宗气指由呼吸清气与水谷精气所化生而聚于胸中之气。宗气的生理功能主要有行呼吸、行气血和资先天三个方面（C错）。肝气疏通、畅达全身气机，使脏腑经络之气的运行通畅无阻，升降出入运动协调平衡（D错）。肾气，即肾精所化之气，是肾脏生理活动的物质基础及其动力来源（E错）。